我国现知最早的药物学专著是
A. 《新修本草》
B. 《神农本草经》
C. 《本草经集注》
D. 《图经本草》
E. 《本草纲目》

正确答案：B。《神农本草经》

解析：本题考查的是历代本草代表作。我国现知最早的药物学专著是《神农本草经》（B对）。《神农本草经》：简称《本经》，为汉代本草代表作。该书系统总结了汉代以前我国药学发展的成就，是现存最早的药学专著，为本草学的发展奠定了基础。《新修本草》（A错）：又称《唐本草》，为隋唐时期唐代的本草代表作。书成于公元659年（唐显庆四年），共54卷，载药850种。本书是我国历史上第一部官修药典性本草，并被今人誉为世界上第一部药典。该书无论在内容和编写形式上都有新的突破，全面总结了唐以前的药物学成就，并很快流传下海内外，对后世医药学的发展影响极大。《本草经集注》（C错）：为魏晋南北朝本草代表作。作者为陶弘景，书成于公元500年左右（南北朝梁代）。该书第一次全面系统地整理、补充了《本经》，反映了魏晋南北朝时期的本草学成就，初步确立了综合性本草著作的编写模式。《图经本草》（D错）被《经史证类备急本草》收录。《经史证类备急本草》：简称《证类本草》，为宋金元时期宋代的本草代表作。作者唐慎微，以掌禹锡的《嘉祐本草》和苏颂的《图经本草》为基础，并收集转录了大量宋以前各代名医对本草的真知灼见、经史传记和佛书道藏中有关本草的论述以及民间防治疾病的经验和单方，撰成此书。书稿定稿于1108年（宋大观二年）以前。该书图文对照，方药并收，医药结合，资料翔实，集宋以前本草之大成，使大量古代文献得以保存，具有极高的学术价值和文献价值。《本草纲目》（E错）：简称《纲目》，为明代本草代表作。作者李时珍，在公元1578年（明万历六年）完成这一巨著。该书不仅集我国16世纪以前药学成就之大成，将本草学的发展提高到一个空前的高度，而且在生物、化学、天文、地理、地质、采矿等方面也有突出的成就，对世界医药学和自然科学的许多领域做出了举世公认的卓越贡献。